弛张热常见的疾病是
A. 伤寒
B. 败血症
C. 肺炎
D. 支气管炎
E. 布鲁菌病

正确答案：B。败血症

解析：弛张热又称败血症热型，常见于败血症（B对）。伤寒热型为稽留热（A错）。大叶性肺炎热型为稽留热、支气管肺炎热型为不规则热（C错）。急性支气管炎主要是低热、慢性支气管炎可不伴有发热症状（D错）。布鲁菌病热型为波状热（E错）。